环孢素引起的牙龈增生不同于苯妥英钠引起牙龈增生的一项是
A. 环孢素引起的增生组织中血管和慢性炎症细胞的成分较多
B. 苯妥英钠引起的增生组织中血管和慢性炎症细胞的成分较多
C. 环孢素引起的增生组织数量明显多于苯妥英钠
D. 苯妥英钠引起的增生组织数量明显多于环孢素
E. 环孢素引起的增生组织大小明显多于苯妥英钠

正确答案：A。环孢素引起的增生组织中血管和慢性炎症细胞的成分较多

解析：本题考查药物性牙龈肥大的病理。环孢素引起的牙龈增生不同于苯妥英钠引起牙龈增生的一项是环孢素引起的增生组织中血管和慢性炎症细胞的成分较多（A对）。苯妥英钠引起的牙龈增生，其病理特点为上皮棘层显著增厚，钉突伸长达到结缔组织深部。结缔组织中有致密的胶原纤维束、大量成纤维细胞和新生的血管，间有多量无定形的基质，炎症细胞很少，常局限于龈沟附近。若继发炎症后，就可有炎症细胞浸润于结缔组织中。环孢素和硝苯地平所引起的牙龈增生其组织学和临床表现均与苯妥英钠所致的牙龈增生相似，但环孢素引起的增生组织中血管和慢性炎症细胞的成分较多。